经翼腭管内通过的内容物包括
A. 腭前、腭中神经
B. 腭中、后神经
C. 鼻腭神经
D. 鼻腭神经、腭神经
E. 腭降动脉及腭神经

正确答案：E。腭降动脉及腭神经

解析：上颌骨体内面（鼻面）参与鼻腔外侧壁的构成，有上颌窦裂孔、向前下方的沟与蝶骨翼突和腭骨垂直部相接构成翼腭管，管内有腭降动脉和腭神经通过。掌握“上颌骨解剖特点”知识点。